常用的减肥膳食包括
A. 低脂、低碳水化合物和低蛋白膳食
B. 低脂、低碳水化合物和高蛋白膳食
C. 低脂、高碳水化合物和低蛋白膳食
D. 低脂、高碳水化合物和高蛋白膳食
E. 高脂、低碳水化合物和低蛋白膳食

正确答案：B。低脂、低碳水化合物和高蛋白膳食